临床上的“双盲”研究是指
A. 研究组接受疫苗，对照组接受安慰剂
B. 观察者和受试对象均不知道受试对象的分组
C. 观察者和受试对象均不知道安慰剂的性质
D. 研究组和对照组都不知道观察者的身份
E. 以上都不是

正确答案：B。观察者和受试对象均不知道受试对象的分组

解析：本题考查双盲的概念。双盲指研究对象和研究实施人员都不了解试验分组情况（B对ACDE错），而是由研究设计者来安排和控制全部试验。